CO浓度增加导致红细胞中碳氧血红蛋白含量随之升高，体现
A. 效应
B. 反应
C. 剂量-效应关系
D. 剂量-反应关系
E. 有的个体不遵循剂量（效应）反应关系规律

正确答案：C。剂量-效应关系